纵隔内不包含
A. 上腔静脉
B. 下腔静脉
C. 心
D. 心包
E. 胸导管

正确答案：B。下腔静脉

解析：纵膈内包含上腔静脉（A对）、心（C对）、心包（D对）、胸导管（E对），不包含下腔静脉（B错，为本题正确答案）。